瓷嵌体与金属嵌体相比，最大的优点是
A. 物理性能稳定
B. 制作工艺简单
C. 机械性能较好，耐磨
D. 色泽协调美观
E. 边缘线短

正确答案：D。色泽协调美观

解析：色泽仿真，美观是瓷嵌体与金属嵌体相比，最大的优点。掌握“金属嵌体”知识点。